中医药教育机构临床基地标准的制定部门为
A. 国务院卫生行政部门
B. 国务院卫生行政部门合同国务院教育行政部门
C. 国务院教育行政部门
D. 国家食品药品监督管理局
E. 国家卫生局

正确答案：A。国务院卫生行政部门

解析：中医药教育机构的设置标准，由国务院卫生行政部门会同国务院教育行政部门制定（B错）；中医药教育机构临床教学基地标准，由国务院卫生行政部门制定（A对）。